患儿，女，8岁，右上颌中切牙外伤冠折，切角缺损，即刻来院就诊。口腔检查发现：穿髓孔大，探痛明显，可疑叩痛。进行这种治疗成功的关键是
A. 保持患儿无痛
B. 保持操作无菌
C. 止血彻底
D. 盖髓剂的选择
E. 拔髓完全

正确答案：B。保持操作无菌

解析：本题考查活髓切断术的关键。患儿，女，8岁，右上颌中切牙外伤冠折（年轻恒牙冠折），切角缺损，即刻来院就诊。口腔检查发现：穿髓孔大，探痛明显，可疑叩痛（牙髓炎），治疗用活髓切断术（E错），进行活髓切断术成功的关键是保持操作无菌（B对）。年轻恒牙牙髓切断术是在局部麻醉下去除冠方牙髓组织，用活髓保存剂覆盖牙髓创面以保存根部正常牙髓组织的方法。年轻恒牙牙髓切断术的主要目的是保留根髓健康活力，促使牙根继续生理性发育，操作过程中要注意避免将氢氧化钙压入根髓组织，减少损伤，防止细菌感染。保持患儿无痛（A错）、止血彻底（C错）、盖髓剂的选择（D错）均是活髓切断术过程中要注意的事项，但不是治疗成功的关键。